检查药物中的残留溶剂，各国药典均采用
A. 重量法
B. 紫外-可见分光光度法
C. 薄层色谱法
D. 气相色谱法
E. 高效液相色谱法

正确答案：D。气相色谱法

解析：本题考查药物中杂质的检查。检查药物中的残留溶剂，各国药典均采用气相色谱法（D对）。由于残留溶剂多具有挥发性，各国药典均采用气相色谱法。重量法（A错）是通过称量物质的质量来确定被测物质组分含量的一种分析方法。分析时，一般是先采用适当方法将被测组分从试样中分离出来，转化为一定的称量形式并称重，由所称得的质量计算被测组分的含量。重量法常用于样品中水分的测定。紫外-分光光度法（B错）可用于在特定波长处有显著吸收的物质如肾上腺素中的酮体的检查。高效液相色谱法（E错）广泛用于药物及其制剂中的有关物质检查，是药物制剂尤其是复方制剂含量测定的首选方法。薄层色谱法（C错）广泛用于样品中一般性杂质的检查，常用内标法、外标法、自身对照法等。